患者，女，30岁。膝足肿胀，屈伸不利，大便溏泻，身倦乏力用药应首选的药物是
A. 桑叶
B. 桂枝
C. 秦艽
D. 薏苡仁
E. 木瓜

正确答案：D。薏苡仁

解析：薏苡仁性味甘淡凉，归脾、胃、肺经，其功效为利水渗湿，健脾止泻，除痹，排脓，解毒散结。可用于治疗膝足肿胀，大便溏泻（D对）。桑叶的功效为疏散风热，清肺润燥，平抑肝阳，清肝明目。治疗风热感冒，温病初起；肺热咳嗽，燥热咳嗽；肝阳上亢，头痛眩晕；目赤肿痛，目暗昏花（A错）。桂枝的功效为发汗解肌，温通经脉，助阳化气，平冲降逆。治疗风寒感冒；脘腹冷痛、经闭痛经、关节痹痛等寒凝血滞诸痛证；痰饮，水肿；心悸，奔豚（B错）。秦艽的功效为祛风湿，清湿热，舒筋络，止痹痛，退虚热。治疗风湿痹证，筋脉拘挛，骨节酸痛；中风半身不遂；湿热黄疸；骨蒸潮热，小儿疳积发热（C错）。木瓜的功效为舒筋活络，和胃化湿。治疗湿痹拘挛，腰膝关节酸重疼痛；脚气浮肿；暑湿吐泻，转筋挛痛（E错）。